女，35岁。5年前出现痛经并逐渐加重，经量较多。妇科检查子宫如60天妊娠大小，质韧，触痛明显，活动好，盆底无触痛结节。考虑诊断为
A. 子宫肌瘤
B. 子宫肉瘤
C. 子宫内膜癌
D. 子宫腺肌病
E. 子宫内膜异位症

正确答案：D。子宫腺肌病

解析：患者为中青年女性（子宫腺肌病多发生于30～50岁经产妇），5年前出现痛经并逐渐加重，经量较多（主要症状是经量过多，经期延长和逐渐加重的进行性痛经），妇检：子宫增大，质韧，触痛明显，活动好（妇科检查子宫呈均匀增大，质硬有压痛），考虑诊断为子宫腺肌病（D对）。子宫肌瘤（P311）（A错）多无明显症状，仅在体检时偶尔发现，常见的症状为经量增多及经期延长，无进行性痛经。子宫内膜癌（P315）（C错）平均发病年龄60岁，主要表现为绝经后阴道流血。子宫肉瘤（P318）（B错）多见于40～60岁以上的女性，常见症状为阴道不规则流血伴腹痛。子宫内膜异位症（P268）（E错）典型症状为逐渐加重的进行性痛经，妇检可发现子宫后倾固定，直肠子宫陷凹、宫底韧带或子宫后壁下方可扪及痛性结节。